多柔比星引起的不良反应是
A. 膀胱炎
B. 肺毒性
C. 耳毒性
D. 心脏毒性
E. 惊厥

正确答案：D。心脏毒性

解析：本题考查多柔比星的不良反应。多柔比星引起的不良反应是心脏毒性（D对）。多柔比星为蒽环类抗肿瘤抗生素，主要不良反应是骨髓抑制和心脏毒性。膀胱炎（A错）是环磷酰胺的典型不良反应。肺毒性（B错）为博来霉素的典型不良反应。耳毒性（C错）是氨基糖苷类抗生素的典型不良反应。